锁骨下动脉
A. 左侧起自头臂干
B. 右侧起于主动脉弓
C. 延续为肱动脉
D. 发出椎动脉
E. 发出胸外侧动脉

正确答案：D。发出椎动脉

解析：锁骨下动脉左侧起自主动脉弓（A错）、右侧起于头臂干（B错）。延续为腋动脉（C错）。发出椎动脉（D对）、胸廓内动脉、甲状颈干、肋颈干（E错）。